男，30岁。反复右下腹痛1年，伴便秘，口腔溃疡，无发热及乏力。否认结核病史及结核密切接触史。查体：右下腹可触及边界不清的包块，可移动，压痛阳性。为明确诊断，最重要的检查是
A. 粪隐血
B. 粪查找抗酸杆菌
C. 腹部CT
D. 结肠镜检查及活检
E. 腹部B超

正确答案：D。结肠镜检查及活检

解析：该患者考虑诊断为克罗恩病，为明确诊断，首选结肠镜检查及活检（D对）：若结肠镜发现纵行溃疡和裂隙溃疡、鹅卵石征，病变间的黏膜正常；活检见裂隙状溃疡、非干酪性肉芽肿、黏膜下层淋巴细胞聚集，则可确诊。粪隐血检查（A错）可判断是否有消化道出血，不能确诊克罗恩病。粪查找抗酸杆菌（B错）主要用于判断肠道内有无结核分枝杆菌感染。腹部CT（D错）及腹部B超（E错）可显示肠壁增厚、腹腔或盆腔脓肿、包块等基本病变表现，不可作为克罗恩病的确诊依据。